流行性出血热的“三痛”是
A. 头痛全身痛和腰痛
B. 头痛关节痛和腰痛
C. 头痛腓肠肌痛和腰痛
D. 头痛眼眶痛和腰痛
E. 头痛腹痛和腰痛

正确答案：D。头痛眼眶痛和腰痛

解析：流行性出血热全身中毒症状为全身酸痛、“三痛”（头痛、腰痛和眼眶痛）（D对），嗜睡或失眠、烦躁、谵妄等神经中毒症状，食欲不振、恶心、呕吐、腹痛、腹泻、呃逆等胃肠道症状。